被列于27种毒性中药材品种的是
A. 闹阳花
B. 肉苁蓉
C. 火麻仁
D. 胖大海
E. 石菖蒲

正确答案：A。闹阳花

解析：本题考查毒性药品。被列于27种毒性中药材品种的是闹羊花（A对）。医疗用毒性药品（简称毒性药品）是指毒性剧烈，治疗剂量与中毒剂量相近，使用不当会致人中毒或死亡的药品。毒性药品中药品种共27种：砒石（红砒、白砒）、砒霜、水银、生马钱子、生川乌、生草乌、生白附子、生附子、生半夏、生南星、生巴豆、斑蝥、青娘虫、红娘子、生甘遂、生狼毒、生藤黄、生千金子、生天仙子、闹羊花、雪上一枝蒿、白降丹、蟾酥、洋金花、红粉、轻粉、雄黄。